患者，男，50岁。咳嗽2个月，痰中带血，不发烧，抗感染治疗效果不明显。3次X线检查均显示右肺中叶炎症。应首先考虑的是
A. 肺炎球菌肺炎
B. 肺结核
C. 肺脓肿
D. 肺癌
E. 支气管扩张

正确答案：D。肺癌

解析：患者中年男性，咳嗽2个月且痰中带血（肺癌常见体征），不发烧，抗感染治疗效果不明显（提示并非肺部感染性疾病）。3次X线检查均显示右肺中叶炎症（肺癌导致的反复发作的同一部位肺炎），应首先考虑的是肺癌（D对）。肺炎球菌肺炎（P44）（A错）起病急，多有寒战、高热、咳铁锈色痰等症状。肺结核（P43）（B错）多有中毒症状，如午后低热、盗汗、疲乏无力、体重减轻等。肺脓肿（P57）（C错）临床特征为高热、咳嗽和咳大量脓臭痰，胸部X线影像显示有一个或多发的含气液的空洞。支气管扩张（P37）（E错）多见于儿童和青年，临床表现主要为慢性咳嗽、咳大量脓痰和（或）反复咯血，抗感染治疗效果较佳。